上下颌运动时，髁突非工作侧受的什么肌肉的牵引力
A. 翼外肌上头
B. 翼外肌下头
C. 咬肌
D. 颞肌前中束
E. 颞肌后束

正确答案：B。翼外肌下头

解析：本题考查咀嚼肌。上下颌运动时，髁突非工作侧受翼外肌下头（B对）的牵引力。翼外肌上头（A错）具有闭口肌的特性，而下头属开口肌，上下头共同发挥稳定关节盘等结构，协同关节运动的作用。双侧咬肌（C错）收缩可使下颌向前上运动，单侧收缩可使下颌向收缩侧方向运动。与咬肌的闭颌作用相比，其在产生咬合力方面更为重要，尤其在磨牙区。颞肌前部肌束（D错）收缩主要使下颌向上运动，中、后部肌束（E错）主要使下颌向后运动。